强心苷对下列哪种原因所致的慢性心功能不全疗效较好
A. 甲状腺功能亢进
B. 维生素B₁缺乏
C. 肺源性心脏病
D. 心力衰竭伴房颤
E. 缩窄性心包炎

正确答案：D。心力衰竭伴房颤